男，55岁。颈后肿痛5天。疼痛逐渐加重，伴畏寒、发热。既往糖尿病病史10年。查体：T38.5℃，P90次/分，R18次/分，BP120/80mmHg，颈后红肿，范围约5cm，边界不清，中央多个脓点。双肺呼吸音清，未闻及干湿性啰音，心律齐。若行切开引流术，下列处理措施错误的是
A. 切口要深达筋膜
B. 切口长度不要超过病变边缘
C. 可行"++”形切口切开引流
D. 未化脓但失活的组织也要清除
E. 术后创面内填塞敷料压迫止血

正确答案：B。切口长度不要超过病变边缘

解析：痈的局部处理：若已出现多个脓点、表面紫褐色或已破溃流脓时，需要及时切开引流。①采用在静脉麻醉下做“＋”“＋＋”形切口（C对）切开引流；②切口的长度应超过病变边缘皮肤（B错，为本题正确答案），深达筋膜（A对）；③清除已化脓和尚未化脓、但已失活的组织（D对）；④然后在脓腔内填塞生理盐水或凡士林纱条（E对），外加干纱布绷带包扎。